正常成人腋测法体温应是
A. 36.0℃～37.0℃
B. 36.2℃～37.0℃
C. 36.2℃～37.2℃
D. 36.4℃～37.4℃
E. 36.5℃～37.5℃

正确答案：A。36.0℃～37.0℃

解析：腋测法是体温测量的常用方法，其操作为将体温计头端置于患者腋窝深处，嘱患者用上臂将体温计夹紧，10分钟后读数。正常成人腋测法体温应是36.0℃～37.0℃（A对）。